女性，30岁，1年前查体发现右侧卵巢肿瘤直径5cm，今晨起突发右下腹痛伴恶心、呕吐。妇检：扪及右下腹肿物增大，有压痛，蒂部最明显，首先的处理是
A. 密切观察
B. 急查盆腔磁共振成像
C. 抗生素治疗
D. 急查血清CA125、甲胎蛋白
E. 剖腹探查或腹腔镜检

正确答案：E。剖腹探查或腹腔镜检

解析：该患者为青年女性，1年前查体发现右侧卵巢肿瘤直径5cm（有卵巢肿瘤病史，肿瘤中等大小），突发右下腹痛伴恶心、呕吐，扪及右下腹肿物增大，有压痛，蒂部最明显（蒂扭转的典型症状是体位改变后突然发生一侧下腹剧痛，常伴恶心、呕吐甚至休克。双合诊检查可扪及压痛的肿块，以蒂部最明显），考虑为卵巢肿瘤蒂扭转。首先的处理是尽快行剖腹探查（E对）。密切观察（A错）、急查盆腔磁共振成像（B错）、抗生素治疗（C错）、急查血清CA125和甲胎蛋白（D错）均与治疗原则不相符，反而耽误最佳手术时机，甚至危及患者生命。